下列引起病毒性心肌炎最常见的病毒是
A. 单纯疱疹病毒
B. 流感病毒
C. 呼吸道合胞病毒
D. 风疹病毒
E. 柯萨奇B组病毒

正确答案：E。柯萨奇B组病毒

解析：引起病毒性心肌炎最常见的病毒是柯萨奇B组病毒（E对），约占30%～50%，其他常见病毒还有：细小病毒B-19，人疱疹病毒6型，孤儿病毒，脊髓灰质炎病毒等。